流行性腮腺炎最常见的并发症是
A. 肺炎
B. 脑膜脑炎
C. 心肌炎
D. 急性肾炎
E. 关节炎

正确答案：B。脑膜脑炎

解析：流行性腮腺炎是由腮腺炎病毒引起的一种常见急性呼吸道传染病，临床上以发热、腮腺非化脓性肿痛为特征。中枢神经系统是腮腺炎病毒最容易侵犯的非腺体组织，约15%的腮腺炎患者有脑膜炎（B对）的表现，患者常有头痛、呕吐、嗜睡、脑膜刺激征，脑脊液与其他病毒性脑炎类似，呈良性经过，一般症状在1周内消失，可完全康复，无后遗症。还可并发脑炎、脑膜脑炎、耳聋、小脑共济失调、面瘫、横断性脊髓炎、多发性神经根炎（格林-巴利综合征）及类脊髓灰质炎综合征。腮腺炎患者也可并发其他脏器损伤，如肾炎（D错）、心肌炎（C错）、甲状腺炎、肺炎（A错）、乳腺炎、前列腺炎、胸腺炎、肝炎、关节炎（E错）、血小板减少等。